女性，35岁。便血伴排便不尽感半月就诊，既往有内痔病史。首选的检查方法是
A. 大便潜血试验
B. 直肠指检
C. 直肠镜检
D. 结肠镜检
E. 钡剂灌肠检查

正确答案：B。直肠指检

解析：患者便血伴排便不尽感（直肠刺激症状），应警惕直肠癌可能，直肠指检是诊断直肠癌最重要的方法，首选的检查方法是直肠指检（B对）。大便潜血试验（A错）为直肠癌的筛查试验，不宜作为首选检查。直肠镜检（C错）较之直肠指诊操作复杂，不宜作为首选检查。结肠镜检（D错）、钡剂灌肠检查（E错）对于直肠病变意义不大，应排除。